在多数情况下，继发性腹膜炎最主要的治疗方法是
A. 静脉注射抗生素
B. 胃肠减压
C. 营养支持
D. 手术治疗
E. 腹腔灌洗

正确答案：D。手术治疗

解析：继发性腹膜炎大多数是腹腔内脏器穿孔或外伤导致内脏破裂所致，需要手术清除病灶，彻底清洁腹腔，因此手术治疗（D对）是其最主要的治疗方法。静脉注射抗生素（A错）、胃肠减压（B错）、营养支持（C错）均为非手术治疗措施，适用于轻度腹膜炎或病程超过24小时，且腹部体征已经得到缓解或不能耐受手术的患者。腹腔灌洗（E错）属于手术治疗的一部分，不能作为单独治疗措施。